某男，7岁，患上呼吸道感染，症见发热，恶风，微有汗出，咳嗽咳痰，咳喘气促，证属外感风热，治属外感风热，治当宣肺清热、止咳祛痰、平喘，宜选用的成药是
A. 鹭鸶咳丸
B. 儿童清肺合剂
C. 清宣止咳颗粒
D. 小儿咳喘灵颗粒
E. 小儿消积止咳口服液

正确答案：D。小儿咳喘灵颗粒

解析：本题考查的是小儿咳喘灵颗粒的功能。某男，7岁，患上呼吸道感染，症见发热，恶风，微有汗出，咳嗽咳痰，咳喘气促，证属外感风热，治属外感风热，治当宣肺清热、止咳祛痰、平喘，宜选用的成药是小儿咳喘灵颗粒（D对）。小儿咳喘灵颗粒：【功能】宣肺清热，止咳祛痰，平喘。鹭鸶咯丸（A错）：【功能】宣肺，化痰，止咳。儿童清肺丸（B错）：【功能】清肺，解表，化痰，止嗽。清宣止咳颗粒（C错）：【功能】疏风清热，宣肺止咳。小儿消积止咳口服液（E错）：【功能】清热肃肺，消积止咳。